治疗腹痛湿热壅滞证，应首选
A. 大承气汤
B. 龙胆泻肝汤
C. 清中汤
D. 枳实导滞丸
E. 泻心汤合连朴饮

正确答案：A。大承气汤

解析：腹痛湿热壅滞证是由于湿热内结，体内气机壅滞，腑气不通，不通则痛。治宜泄热通腑，行气导致，首选大承气汤（A对）。龙胆泻肝汤功能清泻肝胆实火，清理肝胆湿热，无泄热通腑之功（B错）。清中汤功能清化湿热，理气和胃，为治疗胃痛湿热中阻证的选方（C错）。枳实导滞丸功能消食导滞，理气止痛，为治疗腹痛饮食积滞证的选方（D错）。泻心汤和连朴饮功能清热化湿，和胃消痞，为治疗痞满湿热阻胃证的选方（E错）。